患者，男，60岁，鼻唇沟毛囊处出现红肿热痛小结节，逐渐肿大隆起3天，近两天中央部坏死，出现脓栓，红肿热痛加重。处理不当容易引起
A. 面部蜂窝织炎
B. 化脓性海绵状静脉窦炎
C. 脑脓肿
D. 化脓性脑膜炎
E. 败血症

正确答案：B。化脓性海绵状静脉窦炎

解析：患者鼻唇沟毛囊处出现红肿热痛小结节，逐渐肿大隆起3天，近两天中央部坏死，出现脓栓诊断为疖，易引起化脓性海绵状静脉窦炎（B对）。面部蜂窝织炎出现红、肿、热、痛等局部症状明显，范围扩大迅速，进而中心坏死、化脓，出现波动感（A错）。脑脓肿典型症状有发热、头痛、呕吐等，有颈部抵抗感、克氏征及布氏征阳性，可引起精神、神经障碍，累及视觉、运动、感觉等系统，重症者可危及生命（C错）。化脓性脑膜炎常表现为发热、剧烈头痛、呕吐、全身抽搐、意识障碍或颈项强直等（D错）。败血症临床上主要表现为寒战、高热，毒血症症状，皮疹、关节痛、肝脾大，感染性休克，迁徙性病灶等（E错）。